32岁经产妇，曾足月分娩2次。月经周期正常，经量中等。查阴道前后壁明显膨出，重度颗粒型宫颈糜烂，宫口松，子宫后倾，正常大，附件未见异常。患者要求避孕，最合适的避孕方法是
A. 安全期避孕
B. 阴茎套避孕
C. 外用避孕药
D. 宫内节育器
E. 口服短效避孕药

正确答案：E。口服短效避孕药

解析：该患者为青年经产妇，处于生育后期，避孕方式选择的原则是：选择长效、安全、可靠的避孕方法，减少非意愿妊娠进行手术带来的痛苦。各种避孕方法（宫内节育器、皮下埋植剂、复方口服避孕药、避孕针、阴茎套等）均适用，根据个人身体状况进行选择。患者妇检阴道前后壁明显膨出，宫口松，不适宜用宫内节育器（D错），且有重度颗粒型宫颈糜烂，研究表明阴茎套与宫颈糜烂的发生有关，故不宜选用阴茎套（B错）。安全期避孕法（A错）又称自然避孕法，并不十分可靠，不宜推广。外用避孕药（C错）又称外用杀精剂，使用失误时，失败率高达20%以上，不作为避孕首选药。故该患者易选择的避孕方法是口服短期避孕药（E对），且该方法使用方便，避孕效果好，不影响性生活。